下述哪个是非植物性神经节
A. 睫状神经节
B. 星状神经节
C. 腹腔神经节
D. 膝神经节
E. 耳神经节

正确答案：D。膝神经节

解析：内脏运动神经为植物性神经节，包括睫状神经节（A错）、星状神经节（B错）、腹腔神经节（C错）、耳神经节（E错）。膝神经节（D对）为内脏感觉神经。